治疗阳痿，疥癣湿疹，应选用的药物是
A. 硫黄
B. 白鲜皮
C. 秦皮
D. 土茯苓
E. 乌梅

正确答案：A。硫黄

解析：硫黄性温而燥，外用有解毒杀虫，止痒疗疮之功，尤为治疥疮之要药。可治疥疮、顽癣瘙痒。硫磺乃纯阳之品，入肾经能补命门之火而助元阳，可用于肾阳衰微，下元虚冷诸证，可治肾虚阳痿（A对）。白鲜皮的功效为清热燥湿，祛风解毒。治疗湿热疮毒，黄水淋漓，湿疹，风疹，疥癣疮癞；湿热黄疸尿赤，风湿热痹（B错）。秦皮的功效为清热燥湿，收涩止痢，止带，明目。治疗湿热泻痢，赤白带下；肝热目赤肿痛，目生翳膜（C错）。土茯苓的功效为解毒，除湿，通利关节。治疗梅毒及汞中毒所致的肢体拘挛、筋骨疼痛；湿热淋浊，带下，疥癣，湿疹瘙痒；痈肿，瘰疬（D错）。乌梅的功效为敛肺，涩肠，生津，安蛔。治疗肺虚久咳；久泻久痢；虚热消渴；蛔厥呕吐腹痛（E错）。